在水溶液中不稳定，放置后可发生β-内酰胺开环，生成无抗菌活性聚合物的药物有
A. 氨苄西林
B. 头孢噻肟钠
C. 阿莫西林
D. 头孢哌酮钠
E. 哌拉西林

正确答案：A、C。氨苄西林；阿莫西林

解析：本题考查β-内酰胺类抗菌药物。氨苄西林（A对）和阿莫西林（C对）水溶液不太稳定，在室温放置24h生成无抗菌活性的聚合物。头孢噻肟钠（B错）、头孢哌酮钠（D错）属头孢菌素类抗生素，分子中β-内酰胺环稳定性好。哌拉西林（E错）在氨苄西林引入哌嗪酮酸基，极性增大，在水溶液中稳定性较好。